纵切片边缘不整齐，呈蝴蝶状；切面灰白色或黄白色，散有黄棕色小油点的饮片是
A. 重楼
B. 姜黄
C. 羌活
D. 川芎
E. 白术

正确答案：D。川芎

解析：本题考查的是川芎的性状鉴别。纵切片边缘不整齐，呈蝴蝶状；切面灰白色或黄白色，散有黄棕色小油点的饮片是川芎（D对）。川芎【性状鉴别】饮片为不规则厚片，外表皮黄褐色或褐色，有皱缩纹。横切片切面黄白色或灰黄色，散有黄棕色小油点，可见明显波状环纹或多角形纹理。纵切片边缘不整齐，呈蝴蝶状，习称“蝴蝶片”，切面灰白色或黄白色，散有黄棕色小油点。质坚实，气浓香，味苦、辛、微甜。重楼（A错）【性状鉴别】饮片为近圆形、椭圆形或不规则片状。表面白色、黄白色或浅棕色，周边表皮黄棕色或棕褐色，粉性或角质。气微，味微苦、麻。姜黄（B错）【性状鉴别】饮片呈类圆形或不规则形厚片。外表皮深黄色，有时可见环节，切面棕黄色或金黄色，角质样，内皮层环纹明显，维管束点状散在。气香特异，味苦、辛。羌活（C错）【性状鉴别】饮片为类圆形、不规则横切或斜切片。表皮棕褐色至黑褐色，切面外侧棕褐色，木部黄白色，有的可见放射状纹理。体轻，质脆。气香，味微苦而辛。白术（E错）【性状鉴别】饮片呈不规则厚片。表面灰黄色或灰棕色，切面黄白色或淡黄棕色，散生棕黄色的点状油室，木部具放射状纹理，烘干者切面角质样，色较深，或有裂隙。质坚实。气清香，味甘、微辛，嚼之略带黏性。